下颌第一磨牙的最小牙尖是哪一个尖
A. 近中颊尖
B. 远中尖
C. 近中舌尖
D. 远中舌尖
E. 远中颊尖

正确答案：B。远中尖

解析：本题考查下颌第一磨牙牙尖的形态特点。远中尖（B对）是下颌第一磨牙最小的牙尖。下颌第一磨牙牙合面有5个牙尖，颊尖短而圆钝，舌尖长而尖锐，远中尖最小，位于颊面与远中面交界处。牙合面可见5个牙尖，近中颊尖（A错）＞远中颊尖（E错）＞远中尖；近中舌尖（C错）＞远中舌尖（D错）＞远中尖，远中尖最小。五个牙尖大小顺序为：近中舌尖＞远中舌尖＞近中颊尖＞远中颊尖＞远中尖。